极易生虫的药材是
A. 肉桂
B. 麦冬
C. 白芷
D. 赤芍
E. 连翘

正确答案：C。白芷

解析：本题考查的是中药饮片贮存中常见的质量变异现象。极易生虫的药材是白芷（C对）。虫蛀，是指饮片被虫蛀蚀，从而降低疗效或失去药用价值的现象。虫蛀对中药的危害较为严重，是一种常见的质量异常现象。淀粉、糖、脂肪、蛋白质等成分，是有利于蛀虫生长繁殖的营养物质，故含上述成分较多的饮片最易生虫，如白芷、北沙参、薏苡仁、柴胡、大黄、鸡内金等。肉桂（A错）易气味散失。气味散失，是指饮片固有的气味在外界因素的影响下，或贮藏日久气味散失或变淡薄。药物固有的气味，是由其所含的各种成分决定的，主要是由挥发性物质组成，这些成分往往是治病的主要物质，如果气味散失或变淡薄，就会使药性受到影响，从而影响药效。饮片发霉、泛油、变色等，均能使其气味散失；环境温度过高，使含挥发油的药物如肉桂、沉香等，气味逐渐散失，失去油润而干枯，且温度越高挥发油挥发得越快；豆蔻、砂仁粉碎后气味会逐渐挥发散失。麦冬（B错）易泛油。泛油：泛油习称“走油”，是指因饮片中所含挥发油、油脂、糖类等，在受热、受潮或贮藏保管不善时其表面返软、发黏、颜色变浑、呈现油状物质并发出油败气味的现象。泛油是一种酸败变质现象，影响疗效，甚至可产生不良反应。含油脂多的饮片，内部油脂易于溢出表面而造成走油现象。一般可分为两种，一种为含挥发油的饮片，其泛油是因挥发油在一定的外界条件下加速外移聚集，随后在外界作用下形成泛油变质，如当归、苍术等；另一种为含脂肪油的饮片，其泛油是因其中的脂肪酸变为游离脂肪酸后才会溢出表面，随后在外界作用下分解、腐败，发生变质，如柏子仁、桃仁、杏仁等。另外，含糖量多的饮片，常因受潮而造成返软而“走油”，如牛膝、麦冬、天冬、熟地、黄精等。赤芍（D错）为易生虫饮片。易生虫饮片：党参、人参、南沙参、冬虫夏草、当归、独活、白芷、防风、板蓝根、甘遂、生地、泽泻、全瓜蒌、枸杞子、大皂角、桑葚、龙眼肉、核桃仁、莲子、薏苡仁、杏仁、青风藤、桑白皮、鹿茸、蕲蛇、鸡内金、菊花、金银花、凌霄花、北沙参、防己、莪术、川贝母、金果榄、佛手、陈皮、砂仁、酸枣仁、红花、闹羊花、蒲黄、芫花、蝉蜕、黄柏、狗肾、地龙、甘草、黄芪、山药、天花粉、桔梗、灵芝、猪苓、茯苓、水蛭、僵蚕、蜈蚣、乌药、葛根、丹参、何首乌、赤芍、苦参、延胡索、升麻、萆薢、大黄、肉豆蔻、淡豆豉、柴胡、地榆、川芎、半夏、玉竹。连翘（E错）的变异现象，2022年考试指南未明确说明。